发热过程中共同的中介环节主要是通过
A. 内生致热原
B. 外生致热原
C. 抗原抗体复合物
D. 环磷酸鸟苷
E. 前列腺素

正确答案：A。内生致热原

解析：产内生致热原细胞在发热激活物的作用下，产生和释放的能引起体温升高的物质，称之为内生致热原。故内生致热原（A对）是发热过程中共同的中介环节。外生致热原（B错）是通过激活产内生致热原细胞使之产生和释放内生致热原，再引起体温升高。抗原抗体复合物（C错）和外生致热原的机制一样。环磷酸鸟苷（D错）和前列腺素（E错）都属于发热中枢调节介质。